阴性结果最有助于排除肺血栓栓塞的检查是
A. 心电图
B. 胸部X线片
C. 血D-二聚体
D. 下肢深静脉彩超
E. 动脉血气分析

正确答案：C。血D-二聚体

解析：血D-二聚体（C对）是交联纤维蛋白在纤溶系统作用下产生的可溶性降解产物，为一个特异性的纤溶过程标志物，对血栓形成具有很高的敏感性。急性PTE时D-二聚体升高，若其含量正常，则对PTE有重要的排除诊断价值，但因特异性差，对PTE无诊断价值。肺栓塞患者心电图（A错）大多呈非特异性心电图异常。胸部X线片（B错）可显示肺动脉阻塞征、肺动脉高压征及右心肥大征。下肢深静脉彩超（D错）为诊断DVT最简便的方法。动脉血气分析（E错）常表现为低氧血症、低碳酸血症。